麻疹合并肺炎需隔离至出疹后
A. 5天
B. 7天
C. 10天
D. 15天
E. 21天

正确答案：C。10天

解析：麻疹属于传染性呼吸道疾病，控制传染源是预防麻疹的重要步骤，对麻疹患者要做到早发现、早报告、早隔离、早治疗，麻疹患者出疹前后5天均有传染性，一般隔离至出疹后5天（A错），合并肺炎或其他并发症的患者应延长至出疹后10天（C对）。